患者，男，66岁，BMI31.2kg/m²，体检时发现血糖异常前来就诊，空腹血糖8.2mmol/L，餐后2小时血糖12.2mmolL，糖化血红蛋白8.0%。患者既往有磺胺类药物过敏史。医师处方二甲双胍片，每次1000mg，每日2次；西格列汀片，每次100mg，每日1次。服用西格列汀需要监测的严重不良反应是
A. 横纹肌溶解症
B. 急性胰腺炎
C. 酮症酸中毒
D. 心脏Q-T间期延长
E. 肌腱炎

正确答案：B。急性胰腺炎

解析：本题考查西格列汀的不良反应。服用西格列汀需要监测的严重不良反应是急性胰腺炎（B对）。横纹肌溶解症（A错）是他汀类药物的典型不良反应。糖尿病（C错）是以慢性血糖升高为特征的一组代谢性疾病，原因可能是由β细胞分泌的胰岛素出现相对或者绝对的缺乏所致，胰岛素缺乏会导致机体脂肪分解加强，生成大量酮体，出现酮症酸中毒。心脏Q-T间期延长（D错）是喹诺酮类药物可能会产生的心脏毒性，该类药物还可引起肌肉痛、腱鞘炎、跟腱炎、肌腱撕裂（E错）等不良反应。